下列均为大气污染对健康的直接损害，除外
A. 急性中毒
B. 机体免疫力下降
C. 儿童佝偻病的发生增加
D. 变态反应
E. 致癌作用

正确答案：C。儿童佝偻病的发生增加

解析：大气污染对健康的直接危害包括急性中毒（A对）和慢性危害。机体免疫力下降（B对）、变态反应（D对）、致癌作用（E对）均属于大气污染对健康直接危害中的慢性危害。儿童佝偻病属于大气污染对健康的间接损害（C错，为本题正确答案）。